女婴，7个月。诊断“化脓性脑膜炎”使用青霉素加头孢曲松纳治疗5天热退，一般情况好转。近两天又发热，伴间断抽搐2次，查体：T39.2℃，前囟饱满。脑脊液检查：白细胞数12×10⁶/L，蛋白质0.4g/L，糖3mol/L，氯化物108mmol/L。患儿病情加重应考虑为
A. 并发脑积水
B. 并发脑水肿
C. 并发脑脓肿
D. 脑膜炎复发
E. 并发硬脑膜下积液

正确答案：E。并发硬脑膜下积液

解析：患儿女婴，7个月（化脓性脑膜炎好发年龄），诊断为“化脓性脑膜炎”，治疗后5天热退，情况好转，近两天又发热（体温下降后再升高），伴间断抽搐2次（惊厥），查体：T 39.2℃（正常值36～37℃），前囟饱满（符合硬脑膜下积液表现）。脑脊液检查：白细胞数12×10⁶/L（正常值0～10×10⁶/L），蛋白质0.4g/L（正常值0.2～0.4g/L），糖3mol/L（正常值2.5～4.5mmol/L）（脑脊液有好转），氯化物108mmol/L（降低，化脑多在此范围，正常值120～130mmol/L）。根据患儿病史、体征、脑脊液检查，患儿病情加重最可能是并发硬脑膜下积液（E对）。并发脑积水（P404）（A错）主要表现为患儿出现烦躁不安、嗜睡、呕吐、惊厥发作，头颅进行性增大，颅缝分离，前囟扩大饱满、头颅破壶音和头皮静脉扩张。脑水肿（B错）是化脓性脑膜炎病理改变之一。并发脑脓肿（C错）白细胞数应显著升高。患儿脑脊液好转，白细胞控制、蛋白质、葡萄糖等指标已正常，不考虑脑膜炎复发（D错）。